珍珠母的功效是
A. 镇心定惊，清肝除翳
B. 平肝疏肝，散风止痒
C. 平肝潜阳，清肝明目
D. 平肝潜阳，纳气定喘
E. 平肝明目，疏散风热

正确答案：C。平肝潜阳，清肝明目

解析：本题考查的是珍珠母的功效。珍珠母的功效是平肝潜阳，清肝明目（C对）。珍珠母：【功效】平肝潜阳，清肝明目，安神定惊，收湿敛疮。珍珠：【性能特点】本品介类重镇兼涩，甘寒清解兼补，入心、肝经。既镇心而安神定惊，治惊悸、失眠、癫痫及惊风；又清肝而明目除翳，治目赤翳障；还解毒敛疮、润肤祛斑，治喉痹口疮、溃疡不敛、皮肤色斑。【功效】安神定惊，明目除翳（A错），解毒敛疮，润肤祛斑。蒺藜：【功效】平肝，疏肝，祛风明目，散风止痒（B错）。磁石：【功效】镇惊安神，平肝潜阳，聪耳明目，纳气平喘（D错）。桑叶：【功效】疏散风热，清肺润燥，平肝明目（E错），凉血止血。